与胆道感染相关的肝脓肿的常见致病菌是
A. 大肠埃希菌
B. 双歧杆菌
C. 金黄色葡萄球菌
D. 铜绿假单胞菌
E. 艰难梭状芽胞杆菌

正确答案：A。大肠埃希菌

解析：胆源性肝脓肿多为肠道内细菌经十二指肠大乳头，沿胆道上行进入肝脏，引起细菌性肝脓肿，常见致病菌是大肠埃希菌（A对）。肝动脉播散及部分原因不明的肝脓肿以金黄色葡萄球菌（C错）多见。双岐杆菌（B错）、铜绿假单胞菌（D错）、艰难梭状芽胞杆菌（E错）不是细菌性肝脓肿的常见致病菌。